男，8岁。2日前出现双眼异物感，逐渐加重，并出现畏光流泪，及多量黏液性分泌物。诊断为沙眼。下列用药不正确的是
A. 全身应用青霉素
B. 局部应用氧氟沙星
C. 局部应用利福平
D. 晚上涂抹四环素眼膏
E. 局部应用红霉素

正确答案：A。全身应用青霉素

解析：患儿诊断为沙眼，沙眼衣原体对四环素族、大环内酯类及氟喹诺类抗菌药物敏感，非急性期局部用药即可，无需全身用药（A错，为本题正确答案）。